Colles骨折
A. “餐叉”样畸形
B. 下肢短缩、外旋畸形
C. 腕下垂
D. 下肢短缩、内旋、内收畸形
E. Dugas征阳性

正确答案：A。“餐叉”样畸形

解析：Colles骨折即伸直型桡骨远端骨折，由于骨折远端向桡、背侧移位，近端向掌侧移位，因此表现为典型的“餐叉”样畸形（A对）（侧面观）、“枪刺刀”畸形（正面观）。下肢短缩外旋畸形（B错）主要见于股骨颈骨折。腕下垂（C错）为桡神经损伤表现。下肢短缩内旋内收畸形（D错）主要见于髋关节后脱位。Dugas征阳性（E错）为主要见于肩关节脱位。